患者，男，75岁，患高血压、冠心病、血脂异常，服用阿托伐他汀、阿司匹林、美托洛尔、赖诺普利、曲美他嗪。近日患者无明显诱因出现肌肉疼痛，可能引起该症状的药物是
A. 阿司匹林
B. 美托洛尔
C. 阿托伐他汀
D. 赖诺普利
E. 曲美他嗪

正确答案：C。阿托伐他汀

解析：本题考查阿托伐他汀钙的不良反应。可能引起该症状的药物是阿托伐他汀钙（C对）。服用羟甲戊二酰辅酶A还原酶抑制剂（他汀类药物）阿托伐他汀钙可增加肌病的发生危险，出现肌肉酸痛。阿司匹林（A错）不良反应较常见的有胃肠道反应。美托洛尔（B错）不良反应主要是支气管痉挛，心脏功能抑制。赖诺普利（D错）不良反应有：轻微且短暂的头痛、眩晕、疲乏、嗜睡、恶心、咳嗽。曲美他嗪（E错）不良反应为胃肠道不适（恶心、呕吐），可能会发生过敏反应。